氯己定含漱液，不正确的一项
A. 广谱抗菌剂
B. 长期含漱使牙面、舌背表面着色
C. 易使细菌产生耐药菌株
D. 每日含漱2次，每次1分钟
E. 有苦味，并使味觉短时改变

正确答案：C。易使细菌产生耐药菌株

解析：本题考查化学药物控制菌斑。氯己定含漱液，不正确的一项是易使细菌产生耐药菌株（C错，为本题的正确答案）。氯已定溶液，又称洗必泰溶液，它是一种广谱抗菌剂（A对），为二价阳离子表面活性剂，可与细菌胞壁表面的阴离子结合，从而改变细菌的表面结构，提高细胞壁的通透性，使氯己定进人细胞质内，杀死细菌。使用0.12%～0.2%的溶液，每天2次，每次10mL，含漱1分钟（D对），可以抑制菌斑形成。氯己定的化学结构稳定，毒性小，长期使用不易形成耐药菌株或造成对人体的损害；氯己定溶液目前仍是牙周病防治的标准含漱剂，也是评判新型含漱剂的金标准。其主要缺点是长期使用会使牙面、舌背和树脂类修复体的表面着色（B对）；有苦味，并使味觉短时改变（E对）；对有些患者的口腔黏膜有轻度刺激等。这些不适症状在停药后均可以消失，牙面色素可通过洁治清除。